心室顺应性下降的常见原因是
A. 钠-钙交换体与Ca2+亲和力下降
B. 心肌收缩性减弱
C. 心肌室壁增厚、纤维化
D. 心律失常
E. 心肌去甲肾上腺素合成减少

正确答案：C。心肌室壁增厚、纤维化

解析：高血压、肥厚性心肌病等可使心肌室壁增厚、纤维化（C对），心室壁成分改变，导致心室顺应性下降，舒张期能容纳的血液减少。